患者咳嗽，咳痰。查体：右侧呼吸动度减弱，语音震颤和语音共振明显增强，右下肺叩诊出现浊音，听诊可闻及支气管呼吸音。应首先考虑的是
A. 肺气肿
B. 右侧气胸
C. 右下肺实变
D. 右下肺不张
E. 右侧胸腔积液

正确答案：C。右下肺实变

解析：本例患者有咳嗽、咳痰病史，查体：右侧呼吸动度减弱，语音震颤和语音共振明显增强，右下肺叩诊出现浊音，听诊可闻及支气管呼吸音。诊断应首先考虑右下肺实变（C对）。肺气肿（A错）查体可见呼吸动度减弱，语音震颤和语音共振减弱，叩诊为过清音，听诊可发现呼吸音减弱。右侧气胸（B错）查体可见右侧呼吸动度减弱或消失，语音震颤和语音共振减弱或消失，叩诊为鼓音，听诊可发现呼吸音减弱或消失。右下肺不张（D错）查体可见右侧呼吸动度减弱，语音震颤和语音共振减弱，叩诊为浊音，听诊可发现呼吸音减弱或消失。右侧胸腔积液（E错）查体可见右侧呼吸动度减弱，语音震颤和语音共振减弱，叩诊为实音，听诊可发现呼吸音减弱或消失。